HLA-Ⅱ类抗原分子由
A. α链和β链以非共价键连接组成
B. β链和γ链以非共价键连接组成
C. α链和γ链以非共价键连接组成
D. α链和β链以共价键连接组成
E. γ链和β链以共价键连接组成

正确答案：A。α链和β链以非共价键连接组成

解析：HLA-Ⅱ类抗原分子由α链和β链以非共价键连接组成。掌握“HLA种类及其产物、医学意义”知识点。